肺主一身之气的运行体现在下述哪个方面
A. 吸入清气
B. 呼出浊气
C. 生成宗气
D. 调节气机
E. 辅心行血

正确答案：D。调节气机

解析：肺主一身之气的运行是指一身之气皆受肺之统领。凡元气、宗气、营气、卫气等，皆需通过肺的呼吸得以敷布；而人体各脏腑活动之气及经络、营卫之气，也都赖肺的调节而实现其升降出入，发挥其各自特有的功能。可见，肺为气之主宰，对全身气机具有调节作用（D对）。肺有节律的呼吸，对全身之气的升降出入起着重要的调节作用。肺的呼吸调匀通畅，节律均匀，和缓有度，则全身之气升降出入通畅协调；肺气宣发，呼出浊气；肺气肃降，吸入清气，所以，吸入清气和呼出浊气是肺气宣发肃降功能的体现（AB错）。肺司呼吸，吸入自然界的清气，而清气是人体之气的重要来源之一，尤其体现于宗气的生成，所以宗气生成是肺主一身之气的生成功能的体现（C错）。肺朝百脉，指全身的血液，都要通过经脉而会聚于肺，经肺的呼吸进行气体交换，而后输布于全身，即肺气助心行血的生理功能，所以辅心行血是肺朝百脉生理功能的体现（E错）。